DiGeorge综合征的免疫学表现是
A. 吞噬细胞缺陷
B. B细胞缺陷
C. 补体缺陷
D. T细胞缺陷
E. 联合免疫缺陷

正确答案：D。T细胞缺陷

解析：DiGeorge综合征即先天性胸腺发育不良综合征，是一种以T淋巴细胞缺陷（D对）为主的原发性免疫缺陷病。患者胚胎期第三、第四咽囊发育障碍，导致胸腺（T细胞的成熟部位）缺如或发育不全，使外周血成熟T细胞数量显著减少。